治疗动脉粥样硬化可选用的药物是
A. 普罗帕酮
B. 噻氯匹定
C. 洛伐他汀
D. 多巴酚丁胺
E. 米诺地尔

正确答案：C。洛伐他汀

解析：本题考查洛伐他汀。治疗动脉粥样硬化可选用的药物是洛伐他汀（C对）。洛伐他汀为他汀类调血脂药，能通过增加动脉粥样硬化斑块的稳定性或使斑块缩小而减少脑卒中或心肌梗死的发生，可用于治疗动脉粥样硬化。普罗帕酮（A错）为Ⅰc类抗心律失常药，适用于室上性和室性心律失常的治疗。噻氯匹定（B错）为抗血小板药，主要用于脑血管和冠状动脉栓塞性疾病。多巴酚丁胺（D错）为β受体激动剂，临床上用于心排血量低和心率慢的心力衰竭患者，其改善左心室功能的作用优于多巴胺。米诺地尔（E错）为钾通道开放药，用于顽固性、原发性或肾性高血压。